正确描述膈神经的是
A. 属于混合性神经
B. 属于运动性神经
C. 属于感觉性神经
D. 含副交感纤维
E. 穿斜角肌纤维入胸腔

正确答案：A。属于混合性神经

解析：膈神经起初在前斜角肌上端的外侧下行，继而沿该肌前面下降至其内侧，在锁骨下动、静脉之间经胸廓上口进入胸腔（E错）。膈神经属于混合性神经（A对），其运动纤维支配膈肌的运动，感觉纤维分布于胸膜、心包以及膈肌下面的部分腹膜。